不属于颗粒剂质量检查项目的是
A. 溶化性
B. 水分
C. 微生物限度
D. 崩解度
E. 粒度

正确答案：D。崩解度